根据《药品经营质量管理规范》，关于药品经营企业人工作业库房的药品储存和养护的说法，错误的是
A. 待销售出库的药品应按色标管理要求标示为绿色
B. 储存药品按批号堆码不同批号的药品不得混垛码放
C. 对直接接触药品最小包装破损的药品应进行隔离并按色标管理要求标示为黄色
D. 储存药品库房的相对湿度应控制在35%～75%

正确答案：C。对直接接触药品最小包装破损的药品应进行隔离并按色标管理要求标示为黄色

解析：本题考查的是药品批发企业药品储存与养护。药品批发企业药品储存中，药品因破损而导致液体、气体、粉末泄漏时，应当迅速采取安全处理措施，防止对储存环境和其他药品造成污染（C错，为本题正确答案）。药品批发企业药品储存过程中，药品因破损而导致液体、气体、粉末泄漏时，应当迅速采取安全处理措施，防止对储存环境和其他药品造成污染药品批发企业药品储存要求：企业应当根据药品的质量特性对药品进行合理储存，并符合以下要求：按包装标示的温度要求储存药品，包装上没有标示具体温度的，按照《中华人民共和国药典》规定的贮藏要求进行储存；储存药品相对湿度（RH）为35%～75%（D对）；在人工作业的库房储存药品，按质量状态实行色标管理：合格药品为绿色（A对），不合格药品为红色，待确定药品为黄色；储存药品应当按照要求采取避光、遮光、通风、防潮、防虫、防鼠等措施；搬运和堆码药品应当严格按照外包装标示要求规范操作，堆码高度符合包装图示要求，避免损坏药品包装；药品按批号堆码，不同批号的药品不得混跺（B对），跺间距不小于5厘米，与库房内墙、顶、温度调控设备及管道等设施间距不小于30厘米，与地面间距不小于10厘米；药品与非药品、外用药与其他药品分开存放，中药材和中药饮片分库存放；特殊管理的药品应当按照国家有关规定储存；拆除外包装的零货药品应当集中存放；储存药品的货架、托盘等设施设备应当保持清洁，无破损和杂物堆放；未经批准的人员不得进入储存作业区，储存作业区内的人员不得有影响药品质量和安全的行为；药品储存作业区内不得存放与储存管理无关的物品。